产后身痛的常见病因不包括
A. 血虚
B. 风寒
C. 血瘀
D. 肝郁
E. 肾虚

正确答案：D。肝郁

解析：产后身痛多为产后营血亏虚，经脉失养或风寒湿邪稽留关节、经络所致，常见的病因有血虚（A对）、血瘀（C对）、外感风寒（B对）、肾虚（E对）。没有肝郁的因素，肝郁多引起气机不畅（D错，为本题正确选项）。